栀子的功效是
A. 清热泻火，除烦止渴
B. 清热泻火，清肺润燥
C. 清热生津，止呕除烦
D. 清热生津，消肿排脓
E. 泻火除烦，凉血利湿

正确答案：E。泻火除烦，凉血利湿

解析：栀子苦寒降泄清利，善清心、肺、三焦之火，导湿热之邪从小便而出。入气分能泻火而除烦，入血分能凉血解毒而止血疗疮，入三焦能清利湿热而利尿退黄。此外，外用还具消肿止痛之功。栀子的功效是泻火除烦，清热利湿，凉血解毒，外用消肿止痛（E对）。清热泻火，除烦止渴（A错）是石膏的功效。清热泻火，清肺润燥（B错）是知母的功效。清热生津，止呕除烦（C错）是芦根的功效。清热生津，消肿排脓（D错）是天花粉的功效。